患者，女，50岁。头痛昏蒙，胸脘满闷，呕吐痰涎，舌苔白腻，脉弦滑。治疗应首选
A. 羌活胜湿汤
B. 半夏白术天麻汤
C. 川芎茶调散
D. 半夏厚朴汤
E. 苓桂术甘汤

正确答案：B。半夏白术天麻汤

解析：题中患者以头痛昏蒙为主症，故诊断为头痛。脾失健运，痰浊中阻，上蒙清窍，清阳不展，故头痛昏蒙；痰阻胸膈，故胸脘满闷；痰浊上逆，则呕吐痰涎；舌苔白腻，脉弦滑均为痰浊内停之征。故辩证为头痛痰浊头痛，治宜健脾燥湿，化痰降逆，方选半夏白术天麻汤（B对）。羌活胜湿汤功能祛风胜湿，为治疗头痛风湿头痛的选方（A错）。川芎茶调散功能疏风散寒止痛作用，为治疗头痛风寒头痛的选方（C错）。半夏厚朴汤功能行气开郁，降逆化痰，为治疗郁证之痰气郁结证选方（D错）。苓桂术甘汤功能通阳利水，为治疗心悸之水饮凌心证的选方（E错）。